出租《药品生产许可证》，没收违法所得，并处罚款的金额为违法所得的
A. 15倍以上至30倍以下
B. 3倍以上至5倍以下
C. 10倍以上至20倍以下
D. 1倍以上至5倍以下
E. 5倍以上至15倍以下

正确答案：D。1倍以上至5倍以下

解析：本题考查伪造、变造、买卖、出租、出借许可证或者药品批准证明文件的法律责任。出租《药品生产许可证》，没收违法所得，并处罚款的金额为违法所得的1倍以上至5倍以下（D对）。伪造、变造、买卖、出租、出借许可证或者药品批准证明文件的法律责任：行政许可是行政机关根据公民、法人或者其他组织的申请，经依法审查，准予其从事特定活动的行为（参见《中华人民共和国行政许可法》第2条）。行政许可具有法律效力，它解除了行政相对人从事特定活动的禁止，赋予了行政相对人相应的权利。《中华人民共和国行政许可法》第9条规定，依法取得的行政许可，除法律、法规规定依照法定条件和程序可以转让的外，不得转让。根据《药品管理法》第一百二十二条规定，伪造、变造、出租、出借、非法买卖许可证或者药品批准证明文件的，没收违法所得，并处违法所得一倍以上五倍以下的罚款；情节严重的，并处违法所得五倍以上十五倍以下（E错）的罚款，吊销药品生产许可证、药品经营许可证、医疗机构制剂许可证或者药品批准证明文件，对法定代表人、主要负责人、直接负责的主管人员和其他责任人员，处二万元以上二十万元以下的罚款，十年内禁止从事药品生产经营活动，并可以由公安机关处五日以上十五日以下的拘留；违法所得不足十万元的，按十万元计算。生产、销售、使用假药单位的行政责任：根据《药品管理法》第一百一十六条规定，生产、销售假药的，没收违法生产、销售的药品和违法所得，责令停产停业整顿，吊销药品批准证明文件，并处违法生产、销售的药品货值金额十五倍以上三十倍以下（A错）的罚款；货值金额不足十万元的，按十万元计算；情节严重的，吊销药品生产许可证、药品经营许可证或者医疗机构制剂许可证，十年内不受理其相应申请；药品上市许可持有人为境外企业的，十年内禁止其药品进口。生产、销售、使用劣药单位的行政责任：根据《药品管理法》第一百一十七条规定，生产、销售劣药的，没收违法生产、销售的药品和违法所得，并处违法生产、销售的药品货值金额十倍以上二十倍以下（C错）的罚款；违法生产、批发的药品货值金额不足十万元的，按十万元计算，违法零售的药品货值金额不足一万元的，按一万元计算；情节严重的，责令停产停业整顿直至吊销药品批准证明文件、药品生产许可证、药品经营许可证或者医疗机构制剂许可证。生产、销售的中药饮片不符合药品标准，尚不影响安全性、有效性的，责令限期改正，给予警告；可以处十万元以上五十万元以下的罚款。